下列各项，不属急性粟粒性肺结核的X线表现的是
A. 密度均匀
B. 大小均匀
C. 分布均匀
D. 边缘清楚
E. 厚壁空洞

正确答案：E。厚壁空洞

解析：厚壁空洞见于肺结核、支气管肺癌等疾病，密度均匀（A对）、大小均匀（B对）、分布均匀（C对）、边缘清楚（D对）属于急性粟粒性肺结核的X线表现（E错，为本题正确答案）。